对鉴别上下尿路感染最有意义的是
A. 中段尿细菌培养阳性
B. 尿路刺激症状
C. 畏寒、发热、腰痛
D. 肾小管浓缩功能正常
E. 尿中白细胞管型

正确答案：E。尿中白细胞管型

解析：对鉴别上下尿路感染最有意义的是尿中白细胞管型（E对），尿中白细胞管型既提示存在感染也提示了感染部位（肾脏）。中段尿细菌培养阳性（A错）只能说明存在感染，不能区别是上下尿路感染。尿路刺激症状（B错）为下尿路感染的突出症状，但是上尿路感染往往伴有尿路刺激症状。畏寒、发热、腰痛（C错）提示全身性感染，严重的下尿路感染也会出现发热、腰痛，不能提示病变性质。肾小管浓缩功能异常提示肾脏功能受损，正常并不能排除上下尿路感染（D错）。